中小学生每天户外活动时间（包括户外的活动、体育锻炼、游戏、休息，徒步往返学校等）应该为
A. 小学生不少于2～2.5小时，中学生不少于1.5～2小时
B. 小学生不少于2.5～3小时，中学生不少于2～2.5小时
C. 小学生不少于3～3.5小时，中学生不少于2～2.5小时
D. 小学生不少于4～4.5小时，中学生不少于3～3.5小时
E. 小学生不少于5～5.5小时，中学生不少于4～4.5小时

正确答案：C。小学生不少于3～3.5小时，中学生不少于2～2.5小时